副作用是由于
A. 药物剂量过大而引起的
B. 用药时间过长而引起的
C. 药物作用选择性低、作用较广而引起的
D. 过敏体质引起
E. 机体生化机制的异常所致

正确答案：C。药物作用选择性低、作用较广而引起的

解析：本题考查副作用。副作用是药物固有的药理学作用所产生的，由于药物的选择性低、作用广泛引起的（C对）。药物剂量过大而引起的（A错）和用药时间过长而引起（B错）的是毒性作用。过敏体质引起（D错）的是变态反应。机体生化机制的异常所致（E错）引起的是特异质反应。